某女，两手指间和掌指关节强直不舒2年，近2周病情加重，关节疼痛，肿大变形，伴活动受限。实验室检查：血沉45mm/h，类风湿因子（﹢﹢）。其诊断是
A. 痛风
B. 风湿性关节炎
C. 类风湿关节炎
D. 系统性红斑狼疮
E. 骨性关节炎

正确答案：C。类风湿关节炎

解析：类风湿性关节炎一般首发部位为近端指尖关节掌指关节、腕，持续或休息后加重的疼痛特点，常见关节变形，对称性多发关节炎，类风湿因子的阳性率为80%，血沉和C反应蛋白在疾病活动期常升高，综合看来该题患者为类风湿性关节炎（C对）。痛风发病急骤，首发部位在第一跖趾关节，且常夜间剧痛，有红肿热痛，一般无关节变形，且血尿酸高于正常值（A错）。风湿性关节炎的典型表现为游走性、多发性大关节炎，以膝、踝、肘、腕、肩等大关节受累为主，局部可出现红、肿、灼热、疼痛和压痛，有时有渗出，但无化脓现象，关节疼痛很少持续一个月以上，通常在2周内消退，缓解后常无明显关节变性，但易反复（B错）。系统性红斑狼疮首发部位为手关节或其他部位，一般无变形，多发于育龄期女性，关节发生骨侵蚀罕见，有特征性的皮疹、口腔溃疡以及肾脏、血液、中枢神经等多系统的损害，抗ds-DNA抗体、抗Sm抗体阳性和高滴度的ANA阳性（D错）。骨关节炎多见于50岁以上者，主要累及膝、髋等负重关节，活动时关节痛加重，可有关节肿胀和积液，骨关节炎患者的ESR多为轻度增快，RF阴性或低滴度阳性（E错）。